取供试品1.0g，加乙醇和乙醚各15ml，用氢氧化钠滴定液（0.1mol/L）滴定，消耗氢氧化钠滴定液不得超过0.5ml用来检查维生素E的
A. 炽灼残渣
B. 酸度
C. 生育酚
D. 正己烷
E. 溶液的澄清度

正确答案：B。酸度